麻疹的隔离期为
A. 至出疹后5天
B. 从接触后1天至皮疹消退
C. 接触后2周至皮疹消退
D. 从出疹至皮疹消退
E. 发疹前1天至出疹后3天

正确答案：C。接触后2周至皮疹消退